最初被定义为由白细胞产生并在白细胞间发挥作用的细胞因子
A. 白细胞介素
B. 干扰素
C. 肿瘤坏死因子
D. 集落刺激因子
E. 趋化因子

正确答案：A。白细胞介素

解析：白细胞介素（IL）简称白介素，最初被定义为由白细胞产生并在白细胞间发挥作用的细胞因子。掌握“细胞因子及受体”知识点。